指牙齿形成器官的上皮或上皮剩余发生的一组囊肿被称为
A. 牙源性肿瘤
B. 牙骨质瘤
C. 唾液腺囊肿
D. 非牙源性囊肿
E. 牙源性囊肿

正确答案：E。牙源性囊肿

解析：牙源性囊肿是指牙齿形成器官的上皮或上皮剩余发生的一组囊肿。掌握“牙源性囊肿”知识点。